关于日平均最高容许浓度的论述哪一项是不正确的
A. 对任何大气污染物均需制订
B. 指任何一天内多次测定的平均浓度的最高容许值
C. 为了防止污染物慢性和潜在性危害而制订的
D. 是污染物在任何24小时内的平均值均不能超过的限值
E. 是以基准值为主要依据并考虑社会、经济、技术等因素制订的

正确答案：A。对任何大气污染物均需制订

解析：本题考查日平均最高容许浓度的相关内容。日平均最高容许浓度指任何一天内多次测定的平均浓度的最高容许值（B对），是污染物在任何24小时内的平均值均不能超过的限值（D对），其最高容许值是按照基准值为主要依据，并考虑社会、经济、技术等因素制订的（E对），用以防止污染物慢性和潜在性危害（B对）。对一些有慢性作用的物质应制订24小时平均浓度限值（A错，为本题正确答案）。